某男，17岁，暑湿季节，突发泄泻腹痛，变黄而黏，肛门灼热，舌质红，苔黄薄腻，脉滑数。葛根芩连丸处方中的黄连，除清胃肠之火而解毒外，又善
A. 除肌表湿热
B. 除上焦湿热
C. 除中焦湿热
D. 除下焦湿热
E. 除三焦湿热

正确答案：C。除中焦湿热

解析：本题考查的是黄连的性能特点。葛根芩连丸处方中的黄连，除清胃肠之火而解毒外，又善除中焦湿热（C对）。黄连：【性能特点】本品大苦大寒，清泄而燥，泄降纯阴，主入心与胃脾经，兼入肝、胆、大肠经。既清热泻火而解热毒，又燥湿、除湿毒而解湿热毒，为治湿热火毒之要药，广泛用于湿热火毒之病证。与黄芩相比，其清热燥湿力较强，作用偏于心及中焦胃脾，最善清心胃之火，除中焦湿热。黄芩：【性能特点】本品苦寒清泄而燥，主入肺与大肠经，兼入胆、脾、胃经。既清热泻火而凉血止血、安胎、解热毒，又燥湿、除湿毒而解湿热毒。为治湿热火毒之要药，广泛用于湿热火毒之病证。与黄连相比，其清热燥湿力较弱，作用偏于上焦肺及大肠，善清上焦湿热（B错），除肺与大肠之火。黄柏：【性能特点】本品苦泄寒清，燥而沉降，入肾、膀胱经。既清泻实热（火）而解热毒，又燥湿、除湿毒而解湿热毒，还清肾火（相火）而退虚热。为治湿热火毒之要药，较广泛用于湿热火毒之病证。与黄连相比，清热燥湿力较弱，作用偏于肾及下焦膀胱，最善清相火，退虚热，除下焦湿热（D错）。集清实火、湿热、退虚热于一体，凡实热火毒、湿热、虚热用之皆宜。栀子：【性能特点】本品苦寒降泄清利，入心、肺、三焦经。既清心肺三焦之火而泻火除烦解毒、凉血止血，又清利膀胱湿热与清泻滑利大肠，导湿热火毒外出（E错），利小便、缓通便、退黄疸。捣烂外敷能散瘀血而消肿止痛。药力较缓，虽味苦而不燥湿，但能缓泻。既走气分，能清泻气分热；又走血分，能清泄血分热。清热泻火不如石膏，长于凉血解毒、退黄、止血、滑利二便。性能特点为除肌表湿热（A错）的中药，2022年考试指南未明确说明。